粉末直接压片时，既可作稀释剂，又可作黏合剂，还兼有崩解作用的辅料是
A. 淀粉
B. 糖粉
C. 氢氧化铝
D. 糊精
E. 微晶纤维素

正确答案：E。微晶纤维素

解析：本题考查片剂的常用辅料。微晶纤维素（E对）主要在口服片剂和胶囊中用作稀释剂和黏合剂，不仅可用于湿法制粒也可用于干法直接压片。还有一定的润滑和崩解作用，在片剂制备中非常有用。淀粉（A错）为片剂常用的稀释剂。糖粉（B错）为片剂常用的稀释剂，黏合力强，可增强片剂硬度，但吸湿性较强，长期贮存会使片剂的硬度过大，延缓崩解或溶出。氢氧化铝（C错）为助流剂和干黏合剂。糊精（D错）常用作片剂的稀释剂，常与蔗糖、淀粉配合使用。